属于行政处分的是
A. 降职
B. 罚款
C. 赔偿损失
D. 恢复名誉
E. 支付违约金

正确答案：A。降职

解析：行政处分的种类主要有警告、记过、记大过、降级、降职、撤职、留用察看、开除等形式。掌握“卫生法的守法、执法和司法”知识点。